使全口义齿获得良好的固位，与下列哪些因素关系重大
A. 印模是否准确
B. 水平颌位记录是否准确
C. 垂直距离是否正常
D. 排牙位置是否准确
E. 基托边缘伸展是否合适

正确答案：A。印模是否准确

解析：准确的印模，要反映口腔解剖形态和周围组织生理功能活动范围，以便使基托与口腔黏膜高度密合，有边缘封闭，从而取得全口义齿良好的固位。水平颌位记录准确能使患者觉得颞下颌关节不紧张、舒适、咀嚼肌力大，咀嚼效能高。排牙要达到的目的是：恢复患者有个体特征的尽可能自然的外观，保存剩余组织结构，达到咀嚼和发音的功能要求。掌握“全口义齿固位及稳定”知识点。